《中国药典》以东莨菪碱和莨菪碱为指标成分进行含量测定的是
A. 防己
B. 天仙子
C. 马钱子
D. 千里光
E. 延胡索

正确答案：B。天仙子

解析：本题考查天仙子中的主要生物碱及其化学结构。天仙子中的主要生物碱及其化学结构天仙子主要的生物碱有莨菪碱和东莨菪碱等。《中国药典》以东茛菪碱和莨菪碱为指标成分对天仙子（B对）进行含量测定，要求两者总量不得少于0.080%。防己中的主要生物碱及其化学结构防己的有效成分为生物碱，《中国药典》以粉防己碱和防己诺林碱为指标成分对防己（A错）进行含量测定，对药材要求两者总量不得少于1.6%；对饮片要求两者总量不得少于1.4%。马钱子中主要生物碱的化学结构与毒性马钱子成熟种子中生物碱含量为1.5%~5%，主要生物碱是士的宁（又称番木鳖碱）、马钱子碱及其氮氧化物，《中国药典》以士的宁和马钱子碱为指标成分对马钱子（C错）进行含量测定，要求士的宁的含量应为1.20%～2.20%，马钱子碱的含量不得少于0.80%。千里光在临床应用中应注意的问题千里光具有肝、肾毒性和胚胎毒性，在使用时应该严格注意。《中国药典》以阿多尼弗林碱为指标成分对千里光（D错）进行限量测定，其中阿多尼弗林碱的含量不得过0.004%。延胡索中的主要生物碱及其化学结构延胡索含有多种苄基异喹啉类生物碱，包括延胡索甲素、延胡索乙素和去氢延胡索甲素等，《中国药典》以延胡索乙素为指标成分对延胡索（E错）进行含量测定，要求含量不得少于0.050%。